舌黏膜
A. 丝状乳头遍布于舌背
B. 菌状乳头斜列于界沟前方
C. 轮廓乳头散在于丝状乳头之间
D. 舌乳头均含有味蕾
E. 舌根背部的黏膜内有舌扁桃体

正确答案：E。舌根背部的黏膜内有舌扁桃体

解析：舌黏膜中，丝状乳头遍布于舌背前2/3(A错)，菌状乳头散在于丝状乳头之间(B错)，轮廓乳头排列于界沟前方(C错)，舌乳头中丝状乳头不含味蕾(D错)，舌根背部黏膜内有舌扁桃体(E对)。